霍乱与其他细菌引起的腹泻，最主要的鉴别点
A. 流行病学史
B. 有无腹痛及里急后重
C. 有无“米泔水”样粪便
D. 有无严重的脱水表现
E. 细菌学检查结果

正确答案：E。细菌学检查结果